尿毒症继发甲状旁腺功能亢进，为抑制甲状旁腺激素水平，宜选用的药物
A. 人促红素
B. 碳酸镧
C. 非诺贝特
D. 氢氧化铝
E. 骨化三醇

正确答案：E。骨化三醇

解析：本题考查骨化三醇。尿毒症继发甲状旁腺功能亢进，为抑制甲状旁腺激素水平，宜选用的药物骨化三醇（E对）。口服骨化三醇即可恢复肠道对钙的正常吸收，纠正低血钙，缓解肌肉骨骼肌疼痛。对于手术后甲状旁腺功能低下，特发性甲状旁腺功能低下和假性甲状旁腺功能低下，服用骨化三醇可以缓解低血钙及其临床症状。重组人促红素（A错）临床上用于肾功能不全所致的肾性贫血、恶性肿瘤化疗所致贫血，外科围手术期的红细胞动员、早产儿贫血。碳酸镧（B错）适用于治疗终末期肾病患者的高磷酸盐血症。非诺贝特（C错）用于治疗成人饮食控制疗法效果不理想的高脂血症。氢氧化铝（D错）长期使用有中毒风险，不推荐用于慢性肾病高磷血症。